口腔扁平苔藓口腔黏膜损害主要特征为
A. 无痛或剧烈疼痛
B. 灰黄色丘疹或条纹
C. 黏膜柔软，弹性正常
D. 触诊光滑，同正常黏膜
E. 多单侧发病，无特定发病部位

正确答案：C。黏膜柔软，弹性正常

解析：口腔扁平苔藓口腔黏膜损害主要特征为珠光白色丘疹或条纹。白纹可交织成网状，或呈树枝状，也可为单线条或绕成环形。损害往往具有明显的左右对称性，黏膜柔软，弹性正常，但有粗糙感，轻度刺激痛。掌握“口腔扁平苔藓”知识点。